固定桥修复一段时间后出现咬合痛，应先做何种辅助检查
A. 测试基牙牙髓活力
B. 检查牙松动度
C. 拍X线片
D. 检查对颌牙
E. 颅脑CT检查

正确答案：C。拍X线片

解析：本题考查固定局部义齿修复后可能出现的问题。固定桥修复一段时间后出现咬合痛，应先拍X线片（C对）。固定桥修复一段时间后出现咬合痛常常是因为咬合创伤、根尖周疾病等，检查的有效方法是拍摄X线片，以检查根尖及牙周组织有无异常。